属于填充剂的是
A. 羧甲基淀粉钠
B. 硬脂酸镁
C. 淀粉
D. 羟丙基甲基纤维素溶液
E. 水

正确答案：C。淀粉

解析：本题考查片剂的常用辅料。稀释剂亦称填充剂。稀释剂的作用不仅是增加片剂的重量（或体积），更重要的是改善药物的压缩成型性，提高含量均匀度，特别是小剂量药物的片剂。片剂常用的稀释剂有淀粉（C对）、蔗糖、糊精、乳糖、预胶化淀粉、微晶纤维素、无机盐类和糖醇类。羧甲淀粉钠（CMS-Na）（A错）为崩解剂。硬脂酸镁（B错）为润滑剂。羟丙甲纤维素（D错）为黏合剂。蒸馏水（E错）为润湿剂。